可摘局部义齿的非适应证为
A. 双侧游离缺失
B. 需升高颌间距离者
C. 牙弓一侧牙槽骨缺损较大
D. 口腔溃疡经久不愈者
E. 新近拔牙者，等待伤口愈合期间

正确答案：D。口腔溃疡经久不愈者

解析：可摘局部义齿的禁忌证①因意识或精神障碍，或行动障碍而生活不能自理的患者，不能摘戴、保管和清洁义齿，或有误吞义齿危险的患者。②有严重的牙体、牙周疾病而未得到完善的治疗和有效控制的患者。③有口腔黏膜病变或其他软硬组织病变，未治愈或未得到有效控制的患者。④缺牙间隙过窄，（牙合）龈距过小，可导致义齿强度不足者。⑤对义齿材料过敏或对义齿的异物感无法克服的患者。掌握“局部义齿类型，肯氏分类及模型观测”知识点。